某医院进行某药治疗高血压的临床试验，疗效评价可选用指标
A. 罹患率、患病率
B. 死亡率，病死率
C. 相对危险度、特异危险度
D. 有效率，治愈率
E. 抗体阳转率、保护率

正确答案：D。有效率，治愈率